女，36岁，因急性一氧化碳中毒入院，治疗1周后症状消失出院。2月后突然出现意识障碍。既往无高血压及脑血管病史。最可能的诊断是
A. 脑出血
B. 脑梗塞
C. 肝性脑病
D. 中毒迟发脑病
E. 中间综合征

正确答案：D。中毒迟发脑病

解析：一氧化碳中毒迟发性脑病是指一氧化碳中毒患者经抢救在急性中毒症状恢复后经过数天或数周表现正常或接近正常的“假愈期”后再次出现以急性痴呆为主的一组神经精神症状。一般发生在急性中毒后的两个月内。本例患者中年女性，因急性一氧化碳中毒入院，治疗1周后症状消失出院，2月后突然出现意识障碍。符合中毒迟发脑病（D对）特点。既往无高血压及脑血管病史，暂不考虑脑出血（A错）和脑梗塞（B错）。患者无黄疸、无肝功能异常等肝脏疾病，排除肝性脑病（C错）可能。中间综合征（E错）是由重型有机磷农药中毒导致神经肌肉接头功能障碍，引起四肢近端肌、Ⅲ-Ⅶ和Ⅹ对颅神经支配的肌肉和呼吸肌麻痹的一组综合征，临床表现有不同程度的呼吸困难、呼吸频率增加和缺氧症状。